椿皮不具有功效是
A. 止血
B. 止带
C. 固精
D. 涩肠
E. 清热燥湿

正确答案：C。固精

解析：本题考查的是椿皮的功效。椿皮不具有功效是固精（C错，为本题正确答案）。椿皮：【功效】清热燥湿（E对），涩肠（D对），止血（B对），止带（A对），杀虫。固精为莲子肉的功效。莲子肉：【功效】补脾止泻，益肾固精，止带，养心安神。